具有统计学显著性意义的研究结果较无显著性意义和无效的结果被报告的可能性更大，属于
A. 引用偏倚
B. 发表偏倚
C. 文献检索偏倚
D. 多次发表偏倚
E. 有偏倚的人选标准

正确答案：B。发表偏倚

解析：本题考查发表偏倚。发表偏倚（B对ACDE错）指有统计学显著性意义的研究结果较无显著性意义和无效的结果被报告和发表的可能性更大。对于无统计学意义的研究，研究者可能认为意义不大，不发表或推迟发表；作为杂志编辑则更有可能对这类论文退稿。